患者就诊要求解决的主要问题属于
A. 主诉
B. 病史
C. 体格检查
D. 初步诊断
E. 医师签名

正确答案：A。主诉

解析：本题考查主诉的定义。患者就诊要求解决的主要问题属于主诉（A对）。病史（B错）中包含了主诉、现病史、既往史、个人史、婚育史、月经史和家族史。体格检查（C错）分为全身检查和专科检查两部分。初步诊断（D错）为经治医师根据患者入院时的病史、临床表现、体格检查和辅助检查，综合分析，作出初步诊断，如初步诊断为多项时，应当主次分明，对待查病例，应列出可能性较大的诊断，要求诊断用语规范。医师签名（E错）为上级医师和书写入院记录的医师签名。